患者女，46岁，反复心悸气促6年，伴肢肿1年。此次于劳累受凉后复发。现症见心悸，喘息不能平卧，颜面四肢浮肿，脘腹痞胀，形寒肢冷，大便溏，小便短少，舌淡，苔薄白，脉沉细无力。查体：心尖搏动向左下移位，心尖区可闻及双期杂音，双下肢水肿。除给氧及西药强心利尿扩血管外，治疗首选
A. 真武汤
B. 保真汤
C. 五苓散
D. 猪苓汤
E. 理中汤

正确答案：A。真武汤

解析：心尖搏动向左下移位（提示患者可能有左心室肥大，最常见的原因是长期高血压病导致高血压性心脏病）。心尖区可闻及双期杂音（心肌梗死时见心尖区粗糙的收缩期杂音或伴收缩中晚期喀喇音）。双下肢水肿（心力衰竭时出现心源性水肿）。水气上逆凌心故见心悸，喘息不能平卧；肾阳不足气化失司，水邪泛溢肌肤故见颜面四肢浮肿，小便短少；水气犯脾，脾失健运故见脘腹痞胀；失于温煦故见形寒肢冷，大便溏；肾阳亏虚，水湿内内停故见舌淡，苔薄白，脉沉细无力（A对）。保真汤具有补虚除热之功效。主治劳证骨蒸体虚，潮热盗汗（B错）。五苓散具有利水渗湿，温阳化气之功效。主治膀胱蓄水证（C错）。猪苓汤具有利水，养阴，清热之功效。主治水热互结证（D错）。理中汤治疗脾胃虚寒证，自利不渴，呕吐腹痛，腹满不食及中寒霍乱，阳虚失血，如吐血、便血或崩漏，胸痞虚证，胸痛彻背，倦怠少气，四肢不温（E错）。